常用于根管机械预备的器械为
A. 根管钻和冲洗器
B. 根管钻和根管锉
C. 金刚砂钻和根管锉
D. 拔髓针和光滑髓针
E. 扩孔钻和螺旋充填器

正确答案：B。根管钻和根管锉

解析：本题考查常用于根管机械预备的器械。根管机械预备是指采用根管切削器械对牙体组织进行切削、成形根管，以去除根管内感染物质，将根管预备成有利于冲洗、封药和充填的形态。常用的根管机械预备的器械为根管钻和根管锉（B对），包括K锉、H锉、G钻，扩孔钻等。而冲洗器（A错）属于根管冲洗器械。金刚砂钻（C错）属于牙体预备用车针，拔髓针和光滑髓针属于拔髓器械和根管清理辅助器械（D错）。而螺旋充填器（E错）属于充填用器械。